女婴，8个月。水样便3天，10余次/日，呕吐3～4次/日，尿量减少。查体体重8Kg，眼窝凹陷，皮肤弹性差，四肢尚暖，血钠125mmol/L。第一天补液总量是
A. 80～100ml/kg
B. 150～180ml/kg
C. 100～120ml/kg
D. 120～150ml/kg
E. 60～80ml/kg

正确答案：D。120～150ml/kg

解析：8个月女婴，尿量减少，眼窝凹陷，皮肤弹性差，四肢尚暖，血钠125mmol/L，可判断为低渗性中度脱水，第一天补液总量的依据是脱水的程度：轻度脱水为90～120ml/kg、中度脱水为120～150ml/kg、重度脱水为150～180ml/kg。所以该患儿第一天补液总量是120～150ml/kg（D对）。